女，25岁。停经77天，晨起恶心伴呕吐、厌油腻30天。尿频1周。平素月经规律。最可能的诊断是
A. 肾盂肾炎
B. 妊娠剧吐
C. 急性胃炎
D. 病毒性肝炎
E. 早孕反应

正确答案：E。早孕反应

解析：育龄期妇女，停经，晨起恶心伴呕吐、厌油腻，最可能的诊断是早孕反应（E对）。